首选用于治疗急性乳腺炎郁乳期的方剂是
A. 托里消毒散
B. 普济消毒饮
C. 瓜蒌牛蒡汤
D. 柴胡清肝汤
E. 五味消毒饮

正确答案：C。瓜蒌牛蒡汤

解析：治疗急性乳腺炎郁乳期需要疏肝清胃，通乳消肿，选用瓜萎牛蒡汤加减（C对）。急性乳腺炎正虚毒恋证，治法：益气和营，托毒生肌，方药：托里消毒散加减（A错）。普济消毒饮具有清热解毒，疏风散邪之功效。主治大头瘟（B错）。柴胡清肝汤养血清火，疏肝散结，治疗血虚火动，肝气郁结，致患鬓疽，初起尚未成脓者，毋论阴阳表里，俱可服之（D错）。急性乳腺炎热毒炽盛证，治法：清热解毒，托里透脓。方药：瓜萎牛蒡汤或五味消毒饮合透脓散加减（E错）。